硫脲类的主要不良反应是
A. 诱发心绞痛
B. 粒细胞缺乏
C. 甲状腺功能减退
D. 血管神经性水肿
E. 肝功能不良

正确答案：B。粒细胞缺乏